医德评价的意义应除外
A. 医务人员自我心理需求的手段
B. 医务人员行为的监视器和调节器
C. 维护医德原则的重要保障
D. 维护医德规范的重要保障
E. 使医德原则、规范转化为医德行为的中介和桥梁

正确答案：A。医务人员自我心理需求的手段

解析：作为医德多种功能实现的主要机制，医德评价具有重要的意义：①医德评价是医德他律要素转化为医德自律要素的必要形式，是医德原则、规范转化为医德行为的中介和桥梁（E对）；②医德评价是营造良好的医德氛围、优化医德生活的重要保证，是维护医德原则、医德规范（CD对）的重要保障；③医德评价是医务人员调整行为和培养医德品质的重要手段，是医务人员行为的监视器和调节器（B对）；④医德评价是医疗卫生保健机构和整个社会的精神文明建设及医学科学健康发展的促进力量。医德评价是为了在评价他人时做到自戒，从而打造自己的医学伦理素质，而不是医务人员自我心理需求的手段（A错，为本题正确答案）。